具有溶血作用的是
A. 香豆素类
B. 蒽醌
C. 黄酮类
D. 皂苷类
E. 木脂素

正确答案：D。皂苷类

解析：本题考查的是皂苷的理化性质。具有溶血作用的是皂苷类（D对）。皂苷溶血性：皂苷的水溶液大多能破坏红细胞，产生溶血现象。因为多数皂苷能与红细胞壁上的胆固醇形成不溶于水的复合物，破坏红细胞的渗透性，导致细胞内渗透压增加而崩解。香豆素类（A错）、蒽醌（B错）、黄酮类（C错）、木脂素（E错）均不具有溶血性。